在周围神经系统，烟碱受体分布于
A. 自主神经节和骨骼肌运动终板
B. 副交感神经所支配的腹腔内脏
C. 副交感神经所支配的心脏和血管
D. 交感神经所支配的汗腺
E. 交感神经所支配的骨骼肌血管

正确答案：A。自主神经节和骨骼肌运动终板